板蓝根颗粒除能清热解毒外，又能
A. 利尿通便
B. 散瘀止痛
C. 消肿散结
D. 散风止痛
E. 凉血利咽

正确答案：E。凉血利咽

解析：本题考查板蓝根的功效。板蓝根颗粒除能清热解毒外，又能凉血利咽（E对）。板蓝根【功效】清热解毒，凉血，利咽。导赤丸【功能】清热泻火，利尿通便（A错）。抗癌平丸【功能】清热解毒，散瘀止痛（B错）。西黄丸【功能】清热解毒，消肿散结（C错）。牛黄上清丸（胶囊、片）【功能】清热泻火，散风止痛（D错）。